在临床医学研究中要求对资料保密，以下哪一点是不属于该范畴的
A. 对研究资料严加保密
B. 对研究成果严加保密
C. 医师与病人之间的保密
D. 研究者与受试者之间的保密
E. 对病人姓名做保密处理

正确答案：B。对研究成果严加保密